椎管内肿瘤压迫脊髓第十胸节，手术时应打开
A. 第七胸椎椎板
B. 第八胸椎椎板
C. 第九胸椎椎板
D. 第十胸椎椎板
E. 无

正确答案：A。第七胸椎椎板

解析：下胸髓节段（T9～T12）约平对同序数椎骨的上3块椎骨，脊髓第十胸节属于下胸髓节段，其平对第七胸椎椎板，因此椎管内肿瘤压迫脊髓第十胸节，手术时应打开第七胸椎椎板（A对）；第八胸椎椎板（B错）平对第十一胸节；第九胸椎椎板（C错）平对第十二胸节；第十胸椎椎板（D错）平对腰髓节段。